片剂的规格系指
A. 标示每片含有主药的重量
B. 每片含有辅料的处方量
C. 测得每片中主药的平均含量
D. 每片重辅料的实际投入量
E. 测得每片的平均重量

正确答案：A。标示每片含有主药的重量

解析：本题考查片剂规格的定义。片剂的规格指标示每片含有主药的重量（A对）。